阅读中枢位于
A. 额下回后部
B. 中央后回
C. 角回
D. 缘上回
E. 无

正确答案：C。角回

解析：阅读中枢在顶下小叶的角回（C对）。